患者脐周腹部闭合性损伤时出现中上腹刀割样疼痛，伴发热呕吐，X线检查提示膈下游离气体，腹穿抽出黄绿色液体，应首先考虑的诊断是
A. 肝破裂
B. 右肾损伤
C. 空肠损伤
D. 结肠损伤
E. 胰腺损伤

正确答案：C。空肠损伤

解析：患者脐周腹部闭合性损伤时出现中上腹刀割样疼痛，伴发热呕吐，X线检查提示膈下游离气体，腹穿抽出黄绿色液体，应首先考虑的诊断是小肠损伤，小肠包括回肠和空肠（C对）。肝破裂（A错）：（1）有右侧胸腹部外伤病史。（2）右上腹部疼痛，有时向右肩部放射、口渴、恶心、呕吐，心慌、气促、面色苍白；触诊时右上腹有明显压痛、反跳痛、肌紧张及肝区叩击痛。若肝损伤出血较多，腹部有移动性浊音，可出现休克。（3）X线摄片可见右膈肌升高；B超或CT检查可发现液性暗区、肝脏移位等。（4）腹腔穿刺于右下腹可抽出不凝血液。结肠损伤（D错）：其主要表现为细菌性腹膜炎，开放性损伤引起的结肠损伤一般在探查时可以诊断。闭合性结肠损伤由于肠内容物呈半流体甚至呈固体形态，流动性小，化学刺激性也小，因而症状体征发展缓慢，为早期诊断带来一定困难，实验室及其他检查：1.X线检查腹腔内有游离气体，但腹膜外位结肠、直肠中下段破裂除外。2.腹腔穿刺与腹腔灌洗如从腹腔抽出有粪臭味的脓性液体将有助于诊断。右肾损伤一般会有血尿，疼痛，发热，休克等（B错）。胰腺损伤（E错）：轻症的临床症状常不典型。较重的胰腺损伤表现为上腹部弥漫性腹膜炎体征及剧烈疼痛症状；刺激膈肌而出现肩背部疼痛，伴恶心、呕吐、腹胀；可因疼痛与大量体液丢失而出现休克；脐周皮肤可呈青紫色，穿刺抽出液或灌洗液淀粉酶含量增高，即可确定为胰腺损伤。